患者不寐，性情急躁易怒，不思饮食，口渴喜饮，目赤口苦，小便黄赤，大便秘结，舌红苔黄，脉弦而数。其治法是
A. 清肝泻火，宁心安神
B. 清肝泻火，镇惊安神
C. 疏肝泻热，佐以安神
D. 清肝利胆，安神定志
E. 清心凉肝，镇惊宁神

正确答案：C。疏肝泻热，佐以安神

解析：本病例以不寐为主诉，故诊断为不寐；本证多因恼怒伤肝，肝失条达，气郁化火，上扰心神，则不寐；肝火偏旺，则性情急躁易怒；肝气犯胃，则不思饮食；肝郁化火，肝火乘胃，胃热，则口渴喜饮；火热上扰，故目赤口苦；小便黄赤，大便秘结，舌红苔黄，脉弦而数，均为热象，故其证候为肝郁化火证，治以疏肝泻热，佐以安神（C对）。选项清肝泻火，宁心安神和选项清肝泻火，镇惊安神，与答案表述相似，考生须参考教材，为干扰项（AB错）。本病例不涉及胆怯易惊等胆经病证（D错）。本病例以肝经火旺为主，无心烦、心悸等心系病证（E错）。